某男，70岁。患消渴病多年，饮食减少，神疲乏力，四肢倦怠，舌淡，苔白，脉来三部举按皆无力，隐隐蠕动指下，此脉象是
A. 微脉
B. 弱脉
C. 缓脉
D. 细脉
E. 虚脉

正确答案：E。虚脉

解析：本题考查的是常见病脉的脉象。患消渴病多年，饮食减少，神疲乏力，四肢倦怠，舌淡，苔白，脉来三部举按皆无力，隐隐蠕动指下，此脉象是虚脉（E对）。虚脉与主病：［脉象］三部脉举按皆无力，隐隐蠕动于指下，令人有一种软而空豁的感觉，是无力脉的总称。［主病］气血两虚，尤多见于气虚。微脉（A错）：“极细而软，按之欲绝，若有若无”。常见于心肾阳衰及暴脱的患者。弱脉（B错）：沉细而应指无力。主气血两虚诸证。缓脉（C错）：仍一息四至，但脉势的来去却有缓慢之感。多见于湿邪致病及脾胃虚弱证。细脉（D错）与主病：［脉象］脉来细小如线，软弱无力，但应指明显。［主病］气血两虚、诸虚劳损，又主湿病。